患者，女，30岁，因肺栓塞使用华法林抗凝治疗。药师除了需要关注患者的合并用药外，还需关注非药物因素对华法林疗效的影响。下列说法正确的有
A. 吸烟可减弱华法林的抗凝作用
B. 大蒜可增强华法林的抗凝作用
C. 菠菜可减弱华法林的抗凝作用
D. 高蛋白饮食可增加华法林的抗凝作用
E. 葡萄柚可增强华法林的抗凝作用

正确答案：A、B、C、E。吸烟可减弱华法林的抗凝作用；大蒜可增强华法林的抗凝作用；菠菜可减弱华法林的抗凝作用；葡萄柚可增强华法林的抗凝作用

解析：本题考查非药物因素对华法林疗效的影响。吸烟（A对）、菠菜（C对）、高蛋白饮食（D错）可减弱华法林的抗凝作用。大蒜（B对）、葡萄柚（E对）可增强华法林的抗凝作用。华法林药效易受食物成分影响。